水谷精微中精纯柔和部分生成的气是
A. 元气
B. 宗气
C. 营气
D. 卫气
E. 谷气

正确答案：C。营气

解析：营气（C对）来源于脾胃运化的水谷精微。水谷之精化为水谷之气，其中精华部分化生营气，并进入脉中运行全身。元气是人体最根本、最重要的气，是人体生命活动的原动力。元气主要由肾所藏的先天之精化生，通过三焦而流行于全身（A错）；宗气的生成有两个来源：一是脾胃运化的水谷之精所化生的水谷之气，二是肺从自然界中吸入的清气，二者相结合生成宗气（B错）；卫气来源于脾胃运化的水谷精微。水谷之精化为水谷之气，其中剽悍滑利部分化生为卫气（D错）。